开展社区预防慢性非传染性疾病的健康教育，从健康传播效果的层次看，以下表述属于健康信念认同的是
A. 经常参加有氧健身活动
B. 相信合理膳食有利预防疾病
C. 不能经常吃新鲜水果蔬菜
D. 知晓肥胖对健康的危害
E. 愿意接受健康指导

正确答案：B。相信合理膳食有利预防疾病